下颌的基本位置正确的是
A. 牙尖交错位
B. 正中关系
C. 息止颌位
D. 以上都不对
E. 选项ABC均正确

正确答案：E。选项ABC均正确

解析：颌位即为下颌骨的位置。比较稳定和常见的有三个：牙尖交错位，后退接触位（正中关系）、下颌姿势位（息止颌位）。掌握“修复学临床检查”知识点。